抗心力衰竭药地高辛可致的主要用药风险是
A. 心脏毒性（折返心律和传导阻滞）
B. 肺毒性（间质性肺炎）
C. 血液毒性（骨髓造血功能障碍）
D. 耳毒性（耳聋）
E. 肾毒性（血肌酐升高）

正确答案：A。心脏毒性（折返心律和传导阻滞）

解析：本题考查地高辛的不良反应。抗心力衰竭药地高辛可致的主要用药风险是心脏毒性（折返心律和传导阻滞）（A对）。地高辛不良反应包括心律失常（如异位和折返心律以及传导阻滞），胃肠道症状(厌食、恶心、呕吐），神经系统症状（视觉障碍、定向障碍和意识错乱）。